患儿，男，5岁，体重25kg，有癫痫病史，青霉素过敏史。因急性胆囊炎合并腹腔感染住院治疗，体征和实验室检查：白细胞计数15.8×10³/L，体温39.5℃，肝、肾功能正常，医师处方美罗培南静脉滴注（说明书规定儿童剂量为一次20mg/kg）。若治疗较长，有可能导致维生素缺乏，应及时补充的维生素是
A. 维生素A
B. 维生素B
C. 维生素C
D. 维生素D
E. 维生素K

正确答案：E。维生素K

解析：本题考查药物的联合应用。若治疗较长，有可能导致维生素缺乏，应及时补充的维生素是维生素K（E对）。美罗培南使用时应注意维生素K缺乏，及时补充。